附子与干姜均有的功效是
A. 补火
B. 回阳
C. 温肺
D. 止呕
E. 降逆

正确答案：B。回阳

解析：本题考查的是附子与干姜的功效。附子与干姜均有的功效是回阳（B对）。附子：【功效】回阳救逆（E错），补火（A错）助阳，散寒止痛。干姜：【功效】温中，回阳，温肺（C错）化饮。干姜善散寒温中、止痛止呕（D错），治阳虚中寒之脘腹冷痛吐泻。